男，45岁，血压80/70mmHg，突发胸痛，心电图V1-V3导连ST段向上抬高0.3-0.5mv，该患者诊断为
A. 急性前壁心肌梗塞
B. 急性下壁心肌梗死
C. 急性后壁心肌梗死
D. 急性前间壁心肌梗塞
E. 急性侧壁心肌梗塞

正确答案：D。急性前间壁心肌梗塞

解析：患者男，45岁，血压80/70mmHg，突发胸痛，心电图V1-V3导连ST段向上抬高0.3-0.5mv（急性前间壁心肌梗塞的表现），结合患者的表现，诊断为急性前间壁心肌梗塞（D对）。